牙髓细胞的来源为
A. 成牙本质细胞
B. 成釉细胞
C. 牙囊
D. 牙乳头的未分化间充质细胞
E. 成牙骨质细胞

正确答案：D。牙乳头的未分化间充质细胞

解析：牙乳头是牙髓的原始组织，当牙乳头周围有牙本质形成时则称为牙髓。牙乳头的未分化间充质细胞分化为星形成纤维细胞即牙髓细胞。掌握“牙体、牙周组织的形成”知识点。